关于精神障碍的住院治疗说法正确的是
A. 精神障碍的住院治疗实行自愿原则
B. 已经发生伤害自身的行为，应对其实施住院治疗
C. 诊断评估有伤害自身危险的，应对其实施住院治疗
D. 已经发生危害他人安全的行为的，应对其实施住院治疗
E. 以上说法均正确

正确答案：E。以上说法均正确

解析：精神障碍的住院治疗实行自愿原则。诊断结论、病情评估表明，就诊者为严重精神障碍患者，即疾病症状严重，导致患者社会适应等功能严重损害、对自身健康状况或者客观现实不能完整认识，或者不能处理自身事务的精神障碍患者，并有下列情形之一的，应当对其实施住院治疗：①已经发生伤害自身的行为，或者有伤害自身的危险的；②已经发生危害他人安全的行为，或者有危害他人安全的危险的。掌握“精神障碍概述、预防、诊断和治疗”知识点。